血清中含量最高的补体成分是
A. C1
B. C2
C. C3
D. C4
E. C5

正确答案：C。C3

解析：补体活化的经典途径指抗原-抗体复合物活化补体形成C3与C5转化酶，在此途径中，C2血浆浓度很低，是补体活化的级联酶促反应的限速成分。C3是血浆中浓度最高的补体成分。掌握“补体的概念，激活途径及调节”知识点。